硫乙拉嗪主要用于
A. 晕动症引起的呕吐
B. 除晕动病外的各种呕吐
C. 胃食管反流病
D. 肿瘤化疗引起的呕吐
E. 内耳眩晕症引起的呕吐

正确答案：B。除晕动病外的各种呕吐

解析：抗精神失常（抗多巴胺）药：氯丙嗪、丙氯拉嗪、硫乙拉嗪、舒必利、阿立必利等，对各种原因的呕吐都有止吐作用，但对晕动病无效（B对）。